关于阈值，下列说法不正确的是
A. 一种化学物对每种效应都可分别有一个阈值。
B. 是一种物质使机体开始发生效应的剂量或浓度。
C. 浓度低于阈值时效应不发生，浓度高于阈值时效应将发生。
D. 一般认为遗传毒性致癌物有可检测的阈值。

正确答案：D。一般认为遗传毒性致癌物有可检测的阈值。

解析：本题考查阈值的相关内容。阈值是一种物质使机体开始发生效应的剂量或浓度（B对）。一种化学物对每种效应都可分别有一个阈值（A对）。浓度低于阈值时效应不发生，浓度高于阈值时效应将发生（C对）。遗传毒性致癌物一般认为无可检测出的阈值（D错，为本题正确答案）。